有关胸廓的描述，正确的是
A. 胸廓由肋、胸骨、胸椎和肩胛骨连结而成
B. 胸廓上口由第1胸椎、第1对肋和胸骨锁切迹围成
C. 胸廓上口向前下方倾斜
D. 胸廓横径小于前后径
E. 胸廓容纳心、肺、脾、肾等器官

正确答案：C。胸廓上口向前下方倾斜

解析：胸廓由 12 块胸椎、 12 对肋、 1 块胸骨和它们之间的连结共同构成（A错）。胸廓上口较小，由胸骨柄上缘、第 1 肋和第 1 胸椎椎体围成，是胸腔与颈部的通道（B错）。胸廓横径大于前后径（D错）。胸廓容纳心、肺（E错）。胸廓上口向前下方倾斜（C对）。